具有典型细胞核和完整细胞器的型微生物是
A. 真菌
B. 衣原体
C. 支原体
D. 病毒
E. 立克次体

正确答案：A。真菌

解析：具有典型细胞核和完整细胞器的微生物应为真菌（A对），衣原体（B错）、支原体（C错）、立克次体（E错）均为原核细胞型微生物，不具有典型的细胞核，病毒（D错）为非细胞型微生物，不具有典型的细胞核及细胞结构。